液体制剂特点的正确表述是
A. 不能用于皮肤、粘膜和人体腔道
B. 药物分散度大，吸收快，药效发挥迅速
C. 液体制剂药物分散度大，不易引起化学降解
D. 液体制剂给药途径广泛，易于分剂量，但不适用于婴幼儿和老年人
E. 某些固体药物制成液体制剂后，生物利用度降低

正确答案：B。药物分散度大，吸收快，药效发挥迅速